在动物实验中，观察氯沙坦药理作用，主要通过测定
A. 肾素活性
B. ACE活性
C. 血管平滑肌细胞内Ca²⁺含量
D. 其抗ATⅡ受体的活性
E. 尿量改变

正确答案：D。其抗ATⅡ受体的活性

解析：氯沙坦属于血管紧张素（AT）Ⅱ受体阻断剂，主要通过阻滞AT₁受体，使Ang Ⅱ收缩血管与刺激肾上腺释放醛固酮的作用受到抑制，导致血压降低，故观察氯沙坦药理作用，主要通过测定其抗ATⅡ受体的活性（D对AB错）。血管平滑肌细胞Ca²⁺含量（C错）、尿量改变（E错）并不是氯沙坦的药理作用。